环孢素临床用于
A. 痛风
B. 器官移植后排异反应
C. 肺结核
D. 带状疱疹
E. 肝

正确答案：B。器官移植后排异反应

解析：本题考查环孢素的临床应用。环孢素为强效免疫抑制剂，用于治疗器官移植（B对）或骨髓移植后的排斥反应。